在对50名某病病例与50名对照的研究中，二者差别不具有统计学意义，可从下述情况中得出结论
A. 因素与疾病无关联
B. 这种差别可能有临床意义
C. 这种差别可能是抽样误差的结果
D. 病例与对照的可比性已被证实
E. 观察者的偏倚已被排除

正确答案：C。这种差别可能是抽样误差的结果